肝气横逆犯脾，属
A. 相克
B. 相侮
C. 相乘
D. 母病及子
E. 子病及母

正确答案：C。相乘

解析：五行相克的顺序是：木克土，土克水，水克火，火克金，金克木。相克太过则为相乘，反向制约则为相侮。肝属木，脾属土，正常生理状态下为木克土，制约太多为相乘（C对AB错）。母病及子（D错）指五行中的某一行异常，累及其子行，导致母子两行皆病。子病及母（E错）指五行中某一行异常，影响到其母行，终导致子母两行皆异常。